为了预防的目的，降低人群易感性主要通过
A. 继发免疫
B. 隐性感染免疫
C. 人工自动免疫
D. 免疫人群移入
E. 病原体的变异

正确答案：C。人工自动免疫